长期在同一劳动环境中从事某一作业活动，机体通过神经系统复合条件反射使得各器官和系统更协调、反应更迅速、能耗节省而效率提高，这种状态称为
A. 一时性共济联系
B. 静力定型
C. 动力定型
D. 生理协调
E. 神经协调

正确答案：C。动力定型